结构中含有二氯苯氨基的药物是
A. 阿司匹林
B. 布洛芬
C. 吲哚美辛
D. 双氯芬酸钠
E. 对乙酰氨基酚

正确答案：D。双氯芬酸钠

解析：本题考查双氯芬酸。双氯芬酸（D对）结构中含有二氯苯氨基。阿司匹林（A错）是乙酰水杨酸，分子中含有羧基、酯键。布洛芬（B错）属于芳基丙酸类，含甲基、羧基。吲哚美辛（C错）是芳基乙酸类，含甲基、羧基、甲氧基、芳酰基。对乙酰氨基酚（E错）含甲基、酚羟基、酰胺键。